食管癌的早期临床表现不包括
A. 食管内异物感
B. 胸臂后针刺样疼痛
C. 咽下食物时哽噎感
D. 进行性吞咽困难
E. 上腹部烧灼感

正确答案：D。进行性吞咽困难